以下哪种方法是在临床上医务人员通过详尽的检查及调查等方法收集信息、资料，经过整理加工后对患者病情的基本认识和判断
A. 诊断
B. 筛检
C. 调查
D. 问卷
E. 检测

正确答案：A。诊断

解析：诊断是指在临床上医务人员通过详尽的检查及调查等方法收集信息、资料，经过整理加工后对患者病情的基本认识和判断。掌握“流行病的诊断和筛检试验及疾病监测”知识点。